社区卫生服务的对象包括
A. 亚健康人群、高危人群、重点保健人群、病人
B. 健康人群、高危人群、重点保健人群、病人
C. 健康人群、亚健康人群、高危人群、病人
D. 健康人群、亚健康人群、高危人群、重点保健人群、病人

正确答案：D。健康人群、亚健康人群、高危人群、重点保健人群、病人

解析：本题考查社区卫生服务的对象。社区卫生服务的对象包括：健康人群、亚健康人群、高危人群、重点保健人群、病人（D对ABC错）。